有关板障静脉的描述，正确的是
A. 是藏于颅盖骨松质中的扁平静脉
B. 该静脉壁薄无瓣膜
C. 向外借导静脉与头皮静脉交通
D. 向内连接硬脑膜窦
E. 以上描述全对

正确答案：E。以上描述全对

解析：板障静脉是藏于颅盖骨松质中的扁平静脉，静脉壁薄无瓣膜，借导血管连接头皮静脉和硬脑膜窦（ABCD对，故E为本题正确答案）。